患者喉中痰鸣如吼，气粗息涌，胸高胁胀，咳痰色黄，烦闷不安，汗出面赤，口渴喜饮，舌红苔黄腻，脉弦滑。其治法是
A. 清热泻肺，豁痰开窍
B. 宣肺化痰，止咳平喘
C. 清热宣肺，化痰定喘
D. 宣肺解表，止咳化痰
E. 泻肺通腑，宣肺清热

正确答案：C。清热宣肺，化痰定喘

解析：根据患者痰热壅肺，肺失清肃，肺气上逆，故喘而气粗息涌；痰热内盛，壅塞肺气，则胸闷胸痛；痰热交结，随肺气上逆，故咳痰色黄，痰鸣如吼；热扰心神，则烦闷不安；里热炽盛，蒸达于外，则汗出面赤；热灼津伤，则口渴喜饮。结合舌脉表现，本病辨证为痰热内蕴，肺失清肃，壅阻气道，宜采用清热宣肺，化痰定喘的治疗方法（C对）。清热泻肺，豁痰开窍用于痰火瘀闭证、痰浊蒙窍证（A错）。宣肺化痰，止咳平喘的治法不能清化痰热（B错）。宣肺解表，止咳化痰的治法用于外感咳嗽的轻者，但是治法中不能体现出来清化痰热（D错）。泻肺通腑，宣肺清热用于痰热壅盛，腑气不通，胸满咳逆，痰涌，便秘等（E错）。